苯二氮类与巴比妥类共同的特点不包括
A. 都具有抗惊厥、抗癫痫作用
B. 都具有镇静催眠作用
C. 都具有抗焦虑作用
D. 剂量加大都有麻醉作用
E. 可致乏力、困倦、嗜睡

正确答案：D。剂量加大都有麻醉作用